处方书写续随子，应付
A. 茺蔚子
B. 千金子
C. 莱菔子
D. 娑罗子
E. 决明子

正确答案：B。千金子

解析：本题考查的是常见的饮片正名与相关别名。处方书写续随子，应付千金子（B对）。千金子别名：续随子。茺蔚子（A错）别名：益母草子、坤草子。莱菔子（C错）别名：萝卜子。娑罗子（D错）别名：梭罗子。决明子（E错）别名：草决明、马蹄决明。